反映水体有机物含碳量的指标是
A. 氨氮
B. 浑浊度
C. 总固体
D. TOD
E. TOC

正确答案：E。TOC

解析：本题考查反映水体有机物含碳量的指标。总有机碳（TOC）（E对ABCD错）是指水中全部有机物的含碳量，它只能相对表示水中有机物的含量，是评价水体有机物污染程度的综合性指标之一。